临床上对有高渗性脱水机水（高血钠性体液容量减少）的患者原则上给予
A. 高渗氯化钠
B. 5%葡萄糖溶液，严重者可静脉内注射2.5%或3%葡萄糖溶液
C. 低渗氯化钠溶液
D. 50%葡萄糖溶液
E. 等渗氯化钠溶液

正确答案：B。5%葡萄糖溶液，严重者可静脉内注射2.5%或3%葡萄糖溶液

解析：高渗性脱水时可给予生理盐水与5% -10%葡萄糖混合液，病情严重者可由静脉滴入（B对）。低渗性脱水原则上给予等渗液（E错）以恢复细胞外液容量。